男，27岁，左下后牙牙龈反复肿胀疼痛3月，检查：左下5缺失，左下6近中倾斜，左下67间牙龈肿胀，探诊易出血，探诊深度4mm，无自发出血现象。牙龈反复肿痛的原因最可能是
A. 血液性疾病
B. 食物嵌塞
C. 牙龈瘤
D. 增生性龈炎
E. 口呼吸

正确答案：B。食物嵌塞

解析：本题考查牙周病的局部促进因素-食物嵌塞。该患者左下5缺失后未及时修复，导致左下6近中倾斜，左下67两邻牙之间失去接触，出现缝隙，使患者在咀嚼时食物从（牙合）面垂直方向嵌入缝隙内，造成垂直性的食物嵌塞（B对），由于嵌塞物的机械刺激作用和细菌的定植，食物嵌塞可引发牙龈和牙周的炎症，出现下列表征和症状：①两牙间发胀或有深隐痛；②牙龈发炎出血，局部有臭味；③龈乳头退缩；④牙周袋形成和牙槽骨吸收，严重者可发生牙周脓肿；⑤牙周膜可有轻度炎症，导致牙齿咬合不适或叩诊不适；⑥根面龋。血液性疾病（A错）引起的牙龈病损有自发性出血倾向，且不易止住。牙龈瘤（C错）患者多在唇颊侧的牙龈乳头处出现圆球形或椭圆形、大小不一的肿块。增生性龈炎（D错）指牙龈组织在慢性炎症的基础上受到某些局部因素刺激而发生的炎症性增生，主要表现为牙龈组织明显的炎性肿胀，同时伴有细胞和胶原纤维的增生，多发生于青少年。口呼吸（E错）可使牙龈表面因外露而干燥以及牙面缺乏自洁作用，可使菌斑堆积而产生龈炎，部分口呼吸患者可发生牙龈肥大，但一般不会引发牙周袋的形成。